甲氧苄啶与磺胺甲噁唑组成复方新诺明的理论基础是
A. 促进吸收
B. 促进分布
C. 减慢排泄
D. 升高血药浓度
E. 两药的药代动力学相似，发挥协同抗菌作用

正确答案：E。两药的药代动力学相似，发挥协同抗菌作用